男婴，3个月，生长发育良好，体重为5Kg，因母亲患有慢性疾病，需停用母乳而改牛奶喂养，该婴儿每天需8％糖牛奶量及另需补充的水分为
A. 350ml 100ml
B. 450ml 150ml
C. 450ml 300ml
D. 650ml 250ml
E. 750ml 300ml

正确答案：C。450ml 300ml

解析：婴儿每天能量需要量约为90kcal/（kg·d），8%糖牛乳100ml供能约100kacl/（kg·d），所以5kg婴儿所需总热量为450kcal/d，所需8%糖牛乳为450ml，另给水分的量=总液量-糖牛乳量=150×5-450=300ml。所以按九版教材本题答案是450ml，300ml。